波低平。应首先考虑
A. 急性心包炎
B. 扩张型心肌病
C. 病毒性心肌炎
D. 风湿性心肌炎
E. 风湿性心脏病

正确答案：C。病毒性心肌炎

解析：患者青年女性，发热、咳嗽、流涕2 周后热退（前驱感染症状），但又出现胸闷、心悸，心率120 次／分（正常值60～100次/分），心律不齐，偶闻期前收缩。心电图：低电压，T 波低平（心肌炎ST段改变）。结合患者病史、体征及心电图表现，考虑诊断为病毒性心肌炎（C对）。急性心包炎（A错）表现为心前区疼痛，常于体位改变、深呼吸、咳嗽、吞咽、卧位尤其当抬腿或左侧卧位时加剧；心脏压塞的症状，可出现呼吸困难、面色苍白、烦躁不安、发绀、乏力、上腹部疼痛、水肿、甚至休克；心包积液对邻近器官压迫的症状。查体出现心包摩擦音及心包积液体征。扩张型心肌病（B错）主要表现为活动时呼吸困难和活动耐量下降，也可出现心功能不全表现，主要体征为心界扩大，听诊心音减弱，常可闻及第三或第四心音。风湿性心肌炎（D错）临床表现主要有胸闷、心前区隐痛、心悸、乏力、恶心、头晕等。可见与体温不相称的心动过速、心律失常、心脏扩大，新出现的心脏杂音、心包积液及心力衰竭等。风湿性心脏病（E错）主要表现为二尖瓣关闭不全及主动脉瓣狭窄。